《中国药典》已不收载的药材产地加工方法是
A. 发汗
B. 蒸
C. 煮
D. 熏硫
E. 切片

正确答案：D。熏硫

解析：本题考查的是常用的产地加工方法。《中国药典》已不收载的药材产地加工方法是熏硫（D错，为本题正确答案）。常用的产地加工方法：1.拣、洗；2.切片（E对）；3.蒸（B对）、煮（C对）、烫；4.搓揉；5.发汗（A对）；6.干燥。熏硫：有的中药材在加工或储藏中常使用硫黄熏蒸以达到杀菌防腐、漂白药材的目的。